下列关于频数表说法错误的是
A. 便于观察离群值
B. 便于观察异常值
C. 便于观察平均值
D. 可以看出频数分布的集中趋势
E. 可以看出频数分布的离散趋势

正确答案：C。便于观察平均值

解析：本题考查频数分布表的相关内容。频数表不便于观察平均值（C错，为本题的正确答案）。可从频数分布表中直接看出分布形态、集中位置（D对）、变异程度（E对）等整体概貌特征，也可从频数分布表和直方图看出数据是否呈对称分布。如果不对称，则可进一步判断数据偏离的方向（AB对）。